女，30岁。G₁P₀，既往月经规律。不规则出血3个月。妇科检查：外阴、阴道无异常，宫颈呈糜烂状，触之易出血。子宫正常大小，双附件区未触及异常。宫颈细胞学提示高度鳞状上皮内病变，阴道镜活检病理为CIN3。首选的治疗为
A. 宫颈局部药物治疗
B. 宫颈光疗
C. 宫颈锥切术
D. 子宫+双侧附件切除术
E. 改良根治性子宫切除术

正确答案：C。宫颈锥切术